平滑面龋损多见于牙冠的什么部位
A. 邻面接触点上方
B. 邻面接触点下方
C. 唇面近（牙合）缘1/3
D. 颊面中1/3处
E. 牙根面

正确答案：B。邻面接触点下方

解析：平滑面龋多见于牙齿邻面接触点下方、颊舌面近龈缘牙颈部。掌握“牙釉质龋”知识点。